某职工早餐食用葱花炒剩米饭后，大约在10点钟感到恶心，随之剧烈地反复呕吐，上腹部剧烈疼痛，头晕无力，腹泻较轻，此病的致病因素可能为
A. 沙门菌
B. 变形杆菌
C. 副溶血弧菌
D. 葡萄球菌
E. 肉毒梭菌

正确答案：D。葡萄球菌